胃大部分切除患者出现贫血，其主要原因是
A. HCl减少
B. 粘液减少
C. 内因子减少
D. HCO₃⁻减少
E. 胃蛋白酶活性减弱

正确答案：C。内因子减少

解析：内因子是胃粘膜壁细胞分泌的糖蛋白，与维生素B₁₂结合形成复合物促进维生素B₁₂的吸收，是维生素B₁₂肠道吸收的必需因子。在胃大部切除术后，胃壁细胞数量减少，导致分泌的内因子减少（C对），维生素B₁₂吸收障碍从而引起巨幼红细胞性贫血。胃大部分切除的患者，会出现HCl减少（A错）、粘液减少（B错）、HCO₃⁻减少（D错），但该三项与贫血的出现关系不大。胃大部分切除的患者不会出现胃蛋白酶的减弱（E错）。